治疗重度一氧化碳中毒首选的氧疗是
A. 鼻导管吸氧
B. 呼吸新鲜空气
C. 人工呼吸
D. 面罩吸氧
E. 高压氧舱

正确答案：E。高压氧舱

解析：一氧化碳中毒时，一氧化碳与血红蛋白结合紧密，不易解离，使血红蛋白结合氧气的功能降低。另一方面一氧化碳还可以抑制血红蛋白释放氧气。高压氧舱治疗通过增大氧分压，使氧浓度增高，远高于一氧化碳浓度，竞争性与血红蛋白结合。所以高压氧舱（E对）是一氧化碳中毒的首选治疗。普通的吸氧方式如鼻导管吸氧（A错）、面罩吸氧（D错）对一氧化碳中毒的救治作用较慢，一氧化碳由碳氧血红蛋白释出时间长。呼吸新鲜空气（B错）可使患者脱离中毒环境，在轻度一氧化碳中毒时可有一定的疗效，但不是重度一氧化碳重度的首选。人工呼吸（C错）在心肺复苏时常用，不用于一般的治疗。